治疗水痘风热轻证的首选方剂是
A. 透疹凉解汤
B. 桑菊饮
C. 银翘散
D. 柴葛解肌汤
E. 宣毒发表汤

正确答案：C。银翘散

解析：该题考查小儿水痘病的辩证以及方药。银翘散治疗水痘风热轻证等于邪犯肺卫证，治法疏风清热，利湿解毒。方药银翘散加减（C对）。透疹凉解汤治疗风疹邪入气营（A错）。桑菊饮辛凉解表，疏风清热，宣肺止咳之功效，主治风温初起（B错）。柴胡葛根汤治疗小儿痄腮之邪犯少阳证（D错）。宣毒发表汤治疗麻疹邪犯肺卫(初热期)（E错）。